蛋白质中多肽链形成α-螺旋时，主要靠哪种次级键维持
A. 疏水键
B. 肽键
C. 氢键
D. 二硫键
E. 待回忆

正确答案：C。氢键

解析：本题考查蛋白质的分子结构。蛋白质中多肽链形成α-螺旋时，主要靠次级键氢键（C对）维持。α-螺旋的每个肽键的N—H和第四个肽键的碳基氧形成氢键，氢键的方向与螺旋长轴基本平行。